直肠指检能够发现的直肠癌约占总数的
A. 40%
B. 50%
C. 60%
D. 70%
E. 80%

正确答案：D。70%

解析：直肠指诊是诊断直肠癌最重要的方法，中国人直肠癌约70%（D对）为低位直肠癌，能在直肠指诊时触及。